生命质量评价适用于
A. 临床疗效的评价
B. 疾病负担评估
C. 人群健康状况的评定
D. 以上都是
E. 以上都不是

正确答案：D。以上都是